缺乏静脉瓣的静脉
A. 面静脉
B. 头静脉
C. 贵要静脉
D. 大隐静脉
E. 小隐静脉

正确答案：A。面静脉

解析：面静脉（A对）缺乏静脉瓣，当面部感染时，若处理不当，如挤压等，可引起颅内感染。